某患者突发呼吸困难，吸气时胸骨上窝锁骨上窝和肋间隙明显凹陷，临床诊断可能是
A. 左心功能不全
B. 右心功能不全
C. 肺气肿
D. 气管异物
E. 大块肺梗死

正确答案：D。气管异物

解析：患者突发呼吸困难，吸气时胸骨上窝锁骨上窝和肋间隙明显凹陷，有吸气性三凹征，可能是气管异物（D对）。源性呼吸困难主要是左心功能不全引起的呼吸困难有劳力性呼吸困难，端坐呼吸，夜间阵发性呼吸困难（A错）。右心功能不全即右心衰竭：右心衰竭时因体循环淤血，有时也会出现呼吸困难，常见于肺源性心脏病。主要机制是右心房压、上腔静脉压力增高，通过压力感受器反射性兴奋呼吸中枢；同时，血氧含量下降、代谢性酸性物质潴留也可刺激呼吸中枢（B错）。肺气肿一般表现早期无症状或稍一活动出现呼吸急促（C错）。肺梗死是肺栓塞后因血流阻断而引起的肺组织坏死，引起肺栓塞的常见栓子是深静脉血栓。临床表现为胸闷、气短、呼吸困难、胸痛、低热、咳血。它发病突然，来势凶猛，病情危重，死亡率高（E错）。